对暗适应是在暗环境中
A. 视觉感受性不断降低的过程
B. 视觉感受性不断提高的过程
C. 视觉感觉阈限不断提高的过程
D. 视觉的差别阈限不断提高的过程
E. 视觉对比度不断提高的过程

正确答案：B。视觉感受性不断提高的过程

解析：暗适应是指当人长时间在明亮环境中突然进入暗处时，最初看不清任何东西，经过一定时间后，视觉敏感度才逐渐增高而看清在暗处的物体的现象，所以暗适应是人眼在暗处对光的敏感度逐渐提高的过程（B对ACDE错）。